抢救大咯血患者时，最不宜采取的体位是
A. 右侧卧位
B. 仰卧位
C. 俯卧位
D. 头低足高位
E. 左侧卧位

正确答案：B。仰卧位

解析：仰卧位最容易造成血液蓄积在呼吸道，不容易及时排出，造成窒息，因此仰卧位是大咯血病人最不宜采取的体位（B错，为本题正确答案）。最佳体位是头低脚高45°俯卧位，头部下垂、面孔上举，这样最容易迅速排出积血（CD对）。左、右侧卧位均比仰卧位利于积血排出，出现窒息的几率低于仰卧位（AE对）。